长期使用可引起维生素K缺乏的药物是
A. 二甲双胍
B. 头孢哌酮
C. 华法林
D. 阿司匹林
E. 异烟肼

正确答案：B。头孢哌酮

解析：本题考查头孢哌酮。长期使用可引起维生素K缺乏的药物是头孢哌酮（B对）。长期使用二甲双胍（A错）可引起维生素B₁₂缺乏。华法林（C错）过量易致各种出血。阿司匹林（D错）不良反应常见胃肠道反应。异烟肼（E错）长期服用可引起维生素B₆缺乏。